欧美医学伦理学（生命伦理学）四原则不含
A. 不伤害
B. 有利
C. 尊重
D. 胆识
E. 公正

正确答案：D。胆识

解析：1989年，美国的比彻姆和查尔瑞斯在《生物医学伦理学原则》一书中提出了四个原则：尊重、不伤害、有利和公正，并逐渐被国际上广泛接受，也被我国医学伦理学引入。掌握“医学伦理的基本原则”知识点。